氯丙嗪引起口干便秘视力模糊的原因是
A. 阻断结节-漏斗通路D₂受体
B. 阻断黑质-纹状体通路D₂受体
C. 阻断中脑-边缘系统和中脑-皮层通路的D₂受体
D. 阻断脑干网状结构上行激活系统α受体
E. 阻断M胆碱受体

正确答案：E。阻断M胆碱受体

解析：氯丙嗪的一般不良反应：抑制中枢出现嗜睡、困倦、乏力等症状；阻断M受体可出现视物模糊、口干、便秘及尿潴留等（E对）。